某人中午食用大量木薯后，晚饭时出现口中苦涩，流涎、头晕、恶心、呕吐、四肢无力等症状。考虑其发病原因为
A. 龙葵素
B. 皂素
C. 氰苷
D. 植物凝集素
E. 生物碱

正确答案：C。氰苷